膝关节半月板叙述错误的是
A. 内侧呈"C"形
B. 下面平坦
C. 外侧较内侧小
D. 外缘较厚
E. 主要增加关节的灵活性

正确答案：E。主要增加关节的灵活性

解析：内侧半月板较大，呈 C 形（A对），前端窄后份宽，外缘与关节囊及胫侧副韧带紧密相连（C对）。半月板作为关节盘主要调整关节面更为适配，减少外力对关节的冲击和震荡 。 此外，分隔而成的两个腔可增加关节运动的形式和范围（E错，为本题正确答案）。